男子的乳房，属
A. 心
B. 肾
C. 脾
D. 肝
E. 胃

正确答案：B。肾

解析：乳房与经络的关系密切，足少阴肾经，上贯肝膈而与乳联。（B对）（ACDE错）。